无分泌激素的功能
A. 松果体
B. 肾上腺
C. 胰岛
D. 精曲小管
E. 卵泡

正确答案：D。精曲小管

解析：松果体（A对）、肾上腺（B对）属于内分泌腺；胰岛（C对）、卵泡（D对）属于内分泌组织；而精曲小管（D错，为本题正确答案）二者都不是。